婴儿期的特点是
A. 容易发生龋齿
B. 体格生长缓慢
C. 口语发育迅速
D. 容易发生消化不良
E. 喜欢参加集体活动

正确答案：D。容易发生消化不良